虚性妇人腹痛与痛经的共同病机是
A. 冲任虚衰，胞脉失于濡养，不荣则痛
B. 冲任阻滞，胞脉失畅，不通则痛
C. 肝血不足，冲任失荣
D. 肾阳虚衰，胞脉失于温煦
E. 气血亏虚，冲任失养

正确答案：A。冲任虚衰，胞脉失于濡养，不荣则痛

解析：妇人腹痛虚证病情缠绵难愈，耗伤气血，冲任虚衰，胞宫失养；痛经虚证不荣则痛，故二者共同病机为冲任虚衰，胞宫失养，不荣则痛（A对）。冲任阻滞，胞脉失畅，不通则痛是实证病机（B错）。痛经虚证的病因病机包括气血虚弱、肾气亏损；妇人腹痛虚证病机包括湿热瘀阻，气滞血瘀，寒湿凝滞，气虚血瘀。故肝血不足，冲任失荣；肾阳虚衰，胞脉失于温煦；气血亏虚，冲任失养不是二者共同的病因病机（CDE错）。